普通培养基最适宜的灭菌方法是
A. 巴氏消毒法
B. 煮沸法
C. 高压蒸气灭菌法
D. 流通蒸气灭菌法
E. 间歇灭菌法

正确答案：C。高压蒸气灭菌法

解析：压力蒸汽灭菌法（高压蒸气灭菌法）（C对）是一种灭菌效果最好的方法，压力蒸汽灭菌器是一个密闭、耐高压蒸锅，灭菌的温度取决于蒸汽的压力，杀灭包括细菌芽孢在内的一切微生物，常用于普通培养基、生理盐水、手术敷料等耐高温、耐湿物品的灭菌。巴氏消毒法（A错）使用较低温度杀灭液体中的病原菌或特定微生物，可保持不耐热成分不被破坏，用于消毒牛乳、酒类（P33）。煮沸法（B错）的原理是利用水煮沸时温度为100℃（1个大气压下），一般细菌繁殖体5分钟能被杀死，常用于消毒食具、剪刀、注射器等（P33）。流通蒸汽灭菌法（常压蒸汽消毒法）（D错）是在1个大气压下100℃水蒸汽进行消毒，常用于ArnolD消毒器，我国的蒸笼具有相同的原理（P33）。间歇灭菌法（间歇蒸汽灭菌法）（E错）是利用反复多次流动的蒸汽间歇加热以达到间歇灭菌的目的，适用于一些不耐高热的含糖、牛奶等培养基（P33）。